某女患者，未婚，发现左侧乳房有肿块。经医生检查判断后拟进行手术治疗。但患者十分担心手术后会影响以后生活质量。经过医生积极解释，患者消除了心理负担并要求保密。在征得患者的家属同意的情况下进行了手术，手术顺利完成，患者满意。这体现了患者的
A. 基本医疗权
B. 知情同意权
C. 疾病认知权
D. 保护隐私权
E. 以上均是

正确答案：E。以上均是

解析：患者的道德权利：就是在医疗活动中，患者在道德上享有的正当权力和利益，其内容如下：①平等医疗权；②知情同意权；③隐私保护权；④损害索赔权；⑤医疗监督权。掌握“医患关系伦理”知识点。